药材茎呈圆柱形，表面淡紫色或紫色，有纵条纹的是
A. 益母草
B. 淫羊藿
C. 茵陈蒿
D. 肉苁蓉
E. 广金钱草

正确答案：C。茵陈蒿